妊娠早期妇女禁用的药品是
A. 维A酸
B. 美托洛尔
C. 烟酸
D. 碳酸钙
E. 青霉素

正确答案：A。维A酸